根据时辰规律给药有助于提高疗效减少不良反应。下列药物中宜在清晨给药的是
A. 氟西汀
B. 辛伐他汀
C. 氯苯那敏
D. 比沙可啶
E. 艾司唑仑

正确答案：A。氟西汀

解析：本题考查药物的适宜服用时间。宜在清晨给药的是氟西汀（A对）。氟西汀属于抗抑郁药，抑郁症状常表现为晨重晚轻，需清晨服用。辛伐他汀（B错）主要降胆固醇，胆固醇合成高峰在夜间，所以是睡前服用。氯苯那敏（C错）易导致嗜睡，所以是睡前服用。比沙可啶（D错）属于缓泻药，服后约12h排便，睡前服用。艾司唑仑（E错）属于镇静催眠药，睡前服用。